患者产后高热，小腹剧痛，恶露有臭气，大便秘结。治疗应首选
A. 少腹逐瘀汤
B. 生化汤
C. 清热调血汤
D. 大黄牡丹皮汤
E. 大柴胡汤

正确答案：D。大黄牡丹皮汤

解析：题中患者产后高热，小腹剧痛，恶露有臭气，为邪毒稽留体内日久，热毒与瘀血结于胞中，阻滞胞脉所致，热灼津液，故大便燥结，辨为感染邪毒证。少腹逐瘀汤功能活血祛瘀，温经止痛，主治寒凝血瘀证（A错）。生化汤功能养血祛瘀，温经止痛，为产后发热血瘀证的选方（B错）。清热调血汤功能清热除湿，化瘀止痛，主治妇人经水将来，腹痛，时作时止，气血俱实者（C错）。产后发热感染邪毒证，伴持续高热，疼痛剧烈者，治宜清热逐瘀、排脓通腑。方用大黄牡丹皮汤（D对）。大柴胡汤功能和解少阳，内泻热结，主治少阳阳明合病（E错）。